治疗虚劳心阳虚者，应首选
A. 桂枝甘草汤
B. 人参养荣丸
C. 保元汤
D. 炙甘草汤
E. 苓桂术甘汤

正确答案：C。保元汤

解析：保元汤功效益气温阳，适用于阳虚气弱之证（C对）。桂枝甘草汤主治发汗过多，其人叉手自冒心，心下悸，欲得按者（A错）。人参养荣丸主治心脾气血两虚证（B错）。天王补心丹合炙甘草汤为胸痹心肾阴虚的代表方（D错）。苓桂术甘汤为痰饮之脾阳虚弱证的代表方（E错）。